面部能触摸到搏动的动脉是
A. 椎动脉
B. 颈内动脉
C. 面动脉
D. 胸廓内动脉
E. 肺动脉

正确答案：C。面动脉

解析：面动脉（C对）在面部的咬肌前缘绕下颌骨下缘处位置表浅，能触摸到其搏动。